下列各项中哪项是食管癌最典型的临床症状
A. 咽下困难
B. 食管反流
C. 进行性咽下困难
D. 上消化道出血
E. 消瘦、恶液质

正确答案：C。进行性咽下困难